梨形心最常见于
A. 主动脉瓣关闭不全
B. 肺动脉瓣关闭不全
C. 二尖瓣狭窄
D. 二尖瓣关闭不全
E. 三尖瓣狭窄

正确答案：C。二尖瓣狭窄

解析：梨形心，由于心尖上翘心房扩张导致。二尖瓣狭窄（C对）时，左心房压力持续上升，左心房增大，心脏呈梨形。主动脉瓣关闭不全（A错），主动脉内的血液反流至左心室，久而久之，导致左心室肥厚，X线下，呈靴形心。肺动脉瓣关闭不全（B错）时右心室和肺动脉干扩大。二尖瓣关闭不全（D错）时常见左心房、左心室增大，晚期可有右心室增大。三尖瓣狭窄（E错）时，右心房排血受阻，右心房增大，上腔静脉扩张。